公共场所经营企业自身卫生管理工作的主要内容不包括
A. 配备卫生管理人员和建立制度
B. 发放“卫生许可证”和“健康合格证”
C. 组织从业人员学习和掌握卫生知识和技能
D. 组织从业人员进行健康检查
E. 开展对顾客的卫生宣传教育

正确答案：B。发放“卫生许可证”和“健康合格证”

解析：本题考查公共场所经营企业自身卫生管理工作的主要内容。公共场所经营企业自身卫生管理工作的主要内容包括：1.配备卫生管理人员和建立制度（A对）；2.组织从业人员学习和掌握卫生知识和技能（C对）；3.组织从业人员进行健康检查（D对）；4.开展对顾客的卫生宣传教育（E对）。发放“卫生许可证”和“健康合格证”（B错，为本题正确答案）是卫生行政部门的工作内容。